结构中含有糖基的抗心力衰竭药物有
A. 盐酸美西律
B. 去乙酰毛花苷
C. 华法林
D. 地高辛
E. 阿司匹林

正确答案：B、D。去乙酰毛花苷；地高辛

解析：本题主要考查抗心力衰竭药物的分类及其结构特征。结构中含有糖基的抗心力衰竭药物有去乙酰毛花苷（B对）、地高辛（D对）。去乙酰毛花苷和地高辛结构中含糖基，通过抑制Na⁺-K⁺-ATP酶，增加细胞内Na⁺的浓度，通过Na⁺-Ca²⁺交换机制，增加细胞内Ca²⁺的浓度，增强心肌的收缩力，对抗心力衰竭。盐酸美西律（A错）临床用于慢性室性心律失常。华法林（C错）是抗凝血药物。阿司匹林（E错）为非甾体类解热镇痛抗炎药。